患者震颤幅度增大并延及全身，呈对称性、节律性四肢抽动，先快后慢，同时心率增快，血压升高，瞳孔扩大，可诊断为癫痫全面性发作的
A. 强直期
B. 痉挛期
C. 阵挛期
D. 痉挛后期
E. 阵挛后期

正确答案：C。阵挛期

解析：全面强直—阵挛发作，通常称为大发作，以意识丧失和全身对称性强直后阵挛为特征。可分为三期：1.强直期 突然意识丧失，摔倒在地，全身骨骼肌持续性收缩；眼肌收缩出现上睑抬起，眼球上窜或凝视咀嚼肌收缩出现口先强张，而后突闭，可咬伤舌；喉肌和呼吸机强直性收缩，发出尖叫声，呼吸停止；颈部和躯干肌肉强直性收缩，使颈部和躯干先屈曲后反张，上肢先上举后旋再内收旋前，双手握拳，拇指内收，下肢自屈曲转为强烈伸直（A错）。2.阵挛期3.发作后期 此期仍有短暂强直阵挛，造成牙关紧闭和大小便失禁。呼吸先恢复，口鼻喷出泡沫或血沫，随后心率、血压、瞳孔等恢复正常，肌张力松弛，意识逐渐恢复（D、E错）。